患者突然仆倒，昏不知人，口吐白沫，四肢抽搐，口中喊叫，无口眼歪斜及半身不遂。其诊断是
A. 中风
B. 痉证
C. 痫证
D. 厥证
E. 眩晕

正确答案：C。痫证

解析：痫病的病机是肝风内动，痰随风动，风痰被阻，心神被蒙，突然仆倒，昏不知人，口吐白沫，四肢抽搐，口中喊叫，无口眼歪斜及半身不遂，特点为一昏二抽三无后遗症（C对）。痉证（B错）不昏迷，厥证（D错）、眩晕（E错）不抽搐，中风（A错）有口眼歪斜、半身不遂的后遗症。